关于先兆临产的特点，下列说法不正确的是
A. 渐增性节律性宫缩
B. 宫颈管不短缩，宫口不扩张
C. 胎儿下降感
D. 见红
E. 宫缩能被强镇静剂抑制

正确答案：A。渐增性节律性宫缩